刺破翼静脉丛引起血肿常见于阻滞麻醉
A. 上牙槽后神经
B. 腭前神经
C. 下牙槽神经
D. 舌神经
E. 颊神经

正确答案：A。上牙槽后神经

解析：本题考查局麻并发症-血肿。翼静脉丛位于颞下窝内，相当于上颌结节后上方处，上牙槽后神经阻滞麻醉进针时针尖沿着上颌结节弧形表面滑动，深约15～16mm，若进针过深，则会进至上颌结节后方刺破翼静脉丛引起血肿（A对）。腭前神经（B错）阻滞麻醉时注射针在腭大孔表面标志稍前处刺入腭黏膜，往后上方推进至腭大孔，不会刺破翼静脉丛。下牙槽神经（C错）阻滞麻醉时针尖一般达到下颌舌平面以上的下颌神经沟附近，不会刺破翼静脉丛。舌神经（D错）麻醉只需在行下牙槽神经阻滞口内法注射后，将注射针退出1cm，注射麻药即可；颊神经（E错）麻醉只需在行下牙槽神经阻滞口内法注射后，在针尖退至肌层黏膜下时注射麻药即可，因此阻滞麻醉舌神经和颊神经都不会刺破翼丛。